鱼腥草除清热解毒外，又能
A. 息风止痉
B. 活血消肿
C. 疏散风热
D. 利尿通淋
E. 凉血止痢

正确答案：D。利尿通淋

解析：本题考查的是鱼腥草的功效。鱼腥草除清热解毒外，又能利尿通淋（D对）。鱼腥草：【功效】清热解毒，排脓消痈，利尿通淋。牛黄：【功效】清热解毒，息风止痉（A错），化痰开窍。雷公藤：【功效】祛风除湿，活血通络，消肿（B错）止痛，杀虫解毒。连翘：【功效】清热解毒，疏散风热（C错），消肿散结，利尿。白头翁：【功效】清热解毒，凉血止痢（E错）。